小儿先能抬头后抬胸，再会坐、立、行，遵循了运动功能发育哪一项规律
A. 由上到下
B. 由近到远
C. 由粗到细
D. 由低级到高级
E. 由简单到复杂

正确答案：A。由上到下

解析：小儿先能抬头后抬胸，再会坐、立、行，遵循了从上到下的规律。掌握“小儿生长发育规律”知识点。